男，35岁。弯腰活动后出现腰部臀部疼痛，腰部活动受限，左小腿麻木。经卧床休息半个月症状略有缓解。查体：腰部压痛，左外踝及足外侧痛觉减退，左侧踝反射减弱，左下肢直腿抬高试验（土）。为明确诊断，最有价值的检查是
A. X线片
B. MRI
C. 核素扫描
D. B超
E. 肌电图

正确答案：B。MRI

解析：患者青年男性，弯腰活动后出现腰部臀部疼痛（前屈位腰部活动受限），左小腿麻木（神经受累表现），卧床休息后症状略有缓解。腰部压痛。左外踝及足外侧痛觉减退，左侧踝反射减弱（骶l神经根受累表现）。综合患者病史、临床表现及体征，可考虑诊断为腰椎间盘突出，为明确诊断，最有价值的检查是MRI（B对）。MRI可以全面的观察各椎间盘退变清况，了解髓核突出的程度和位置，鉴别是否存在椎管内其他占位性病变。在腰椎间盘突出症的病人，X线片（A错）的表现可以完全正常，但很多病人也会有一些阳性发现。核素扫描（C错）、B超（D错）并不适用于腰椎间盘突出的诊断。肌电图有助于腰椎间盘突出的诊断，但不是最有价值的。